在病例对照研究中，选择对照的要求是
A. 未患病的人
B. 病例来源的人群中未患某病，其他特征与病例组相同
C. 病例来源的人群中未患所研究的疾病，某些可能影响患病的因素与病例组具有可比性的人
D. 未患某病，其他特征与病例组相同

正确答案：C。病例来源的人群中未患所研究的疾病，某些可能影响患病的因素与病例组具有可比性的人

解析：本题考查病例对照研究的调查对象。病例对照研究的调查对象是以当前已经确诊的患有某特定疾病的一组病人作为病例组，以不患有该病但具有可比性的一组个体作为对照组（C对ABD错）。